低镁血症时神经－肌肉兴奋性增高的机制是
A. 静息电位负值变小
B. 阈电位降低
C. γ－氨基丁酸释放增多
D. 乙酰胆碱释放增多
E. ATP生成增多

正确答案：D。乙酰胆碱释放增多

解析：Mg2+和Ca2+竞争进入轴突，低镁血症时则Ca2+进入增多，导致轴突释放乙酰胆碱增多（D对），使神经-肌肉接头处兴奋传递加强。镁缺乏可使Na+-K+-ATP酶活性降低（E错），静息电位负值变大（A错），阈电位升高（B错）。镁对中枢神经系统具有抑制作用，镁缺乏时不会出现γ－氨基丁酸释放增多（D错）。